男性，18岁，二个月前，因急性脓胸经多次胸腔穿刺抽脓及抗菌治疗后，仍有低热、消瘦，胸部X片右胸仍可见有包裹性脓腔，入院后行胸腔闭式引流术，每日引流脓液30～50ml，胸片及胸部CT显示右下胸部有一10×6cm²残腔，壁厚约2mm，未见钙化，肺内未见病变，进一步治疗应选择
A. 继续改进胸腔引流
B. 将闭式引流改为开放引流
C. 胸膜纤维板剥除术
D. 胸膜肺切除术
E. 改进全身情况，消除中毒症状和营养不良

正确答案：C。胸膜纤维板剥除术

解析：青少年男性患者，急性脓胸经治疗后，仍有低热、消瘦，X线片右胸仍可见有包裹性脓腔，提示患者治疗效果不佳。行胸腔闭式引流术后，右下胸部有一残腔，壁厚约2mm（提示脓胸已进入慢性期），结合患者病史临床表现和影像学检查，应诊断为右侧慢性脓胸。由于患者病程较短，脓腔壁（即纤维板）较薄、粘连尚不紧密，且未合并肺内严重病变，因此进一步治疗应选择胸膜纤维板剥除术（C对），以改善肺功能和胸廓呼吸运动。继续改进胸腔引流（A错）、将闭式引流改为开放引流（B错）主要用于引流不畅的患者，且两者均只能缓解患者的症状，不能从根源上消除脓腔。胸膜肺除术（D错）主要用于慢性脓胸合并支气管扩张、结核性空洞等严重费内病变的患者，患者未合并肺内严重病变，故不选。改进全身情况，消除中毒症状和营养不良（E错）只是一般辅助治疗措施，不能从根源上消除慢性脓胸的病变进展。